栓塞类型中最常见的是
A. 气体栓塞
B. 细菌栓塞
C. 羊水栓塞
D. 血栓栓塞
E. 脂肪栓塞

正确答案：D。血栓栓塞

解析：栓塞有多种类型，其中最常见的是血栓栓塞（D对），约占99%以上。气体栓塞（A错）、细菌栓塞（B错）、羊水栓塞（C错）和脂肪栓塞（E错）均少见。